农村新型合作医疗的特点是，除了
A. 全国统一形式
B. 政府引导，农民自愿参加
C. 以大病统筹为主要形式
D. 健全合作医疗管理机构
E. 强化政府在农民医疗保障中的责任

正确答案：A。全国统一形式

解析：新型农村合作医疗是由政府组织、引导、支持，农民自愿参加，个人、机关和政府多方筹资，以大病统筹为主的农民医疗互助共济制度。新型农村合作医疗的覆盖对象为所有农村居民，乡镇企业职工（不含以农民家庭为单位参加新型农村合作医疗的人员）是否参见新型农村合作医疗由县级人民政府确定。新型农村合作医疗制度实行个人缴费、集体扶持和政府资助相结合的筹资机制。掌握“医疗保障”知识点。